从胆汁中排出的药物或代谢物，在小肠中转运期间又重吸收返回门静脉的现象
A. 胃排空速率
B. 肝肠循环
C. 首过效应
D. 代谢
E. 吸收

正确答案：B。肝肠循环

解析：本题考查肝肠循环。肠肝循环（B对）是指随胆汁排入十二指肠的药物或其代谢物，在肠道中重新被吸收，经门静脉返回肝脏，重新进入血液循环的现象；胃排空速率（A错）指胃排空的快慢；首过效应（C错）是指经胃肠道代谢的药物在进入血液循环之前被代谢，进入血液循环的原形药量减少的现象；代谢（D错）是生物体内所发生的用于维持生命的一系列有序的化学反应的总称；吸收（E错）是药物由给药部位进入血液循环的过程。